何种情况下机体由脂肪提供能量
A. 长期饥饿
B. 空腹
C. 进餐后
D. 剧烈运动
E. 安静状态

正确答案：A。长期饥饿